造成患病率升高的因素不包括
A. 新病人增加
B. 生存率提高
C. 治疗水平提高
D. 治愈率提高
E. 诊断水平提高

正确答案：D。治愈率提高

解析：本题考查影响患病率的因素。引起患病率降低的主要因素：①新病例减少（发病率下降）；②病死率增高；③病程缩短；④治愈率提高（D错，为本题正确答案）；⑤健康者迁入；⑥病例迁出。